药源性疾病是由药品不良反应发生程度较严重或持续时间过长引起，下列关于药源性疾病的防治措施，不恰当的是
A. 依据病情和药物适应证，正确选用药物
B. 根据治疗对象的个体差异，建立合理的给药方案
C. 监督患者的用药行为，及时调整给药方案和处理不良反应
D. 慎重使用新药，实行个体化给药
E. 尽量增加联合用药

正确答案：E。尽量增加联合用药

解析：本题考查药源性疾病。尽量减少联合用药（E错，为本题正确答案），避免不良的药物相互作用；要防治药源性疾病，应依据病情和药物适应证，正确选用药物（A对）；根据治疗对象的个体差异，建立合理的给药方案（B对）；监督患者的用药行为，及时调整给药方案和处理不良反应（C对）；慎重使用新药，实行个体化给药（D对）。